生物利用度最高的给药途径
A. 经皮给药
B. 直肠给药
C. 吸入给药
D. 口腔黏膜给药
E. 静脉给药

正确答案：E。静脉给药

解析：本题考查药物的给药方式。静脉给药（E对）药物直接进入血液循环，生物利用度为100%；经皮给药（A错）药物由皮肤吸收；直肠给药（B错）药物由直肠黏膜血管吸收；吸入给药（C错）药物吸收肺部吸收；口腔黏膜给药（D错）有吸收过程。